为了比较各国家、各地区龋齿的患病情况，WH0规定的龋齿患病水平衡量标准是多大年龄儿童龋均
A. 5～8岁
B. 12岁
C. 12～15岁
D. 15岁
E. 25岁

正确答案：B。12岁

解析：本题考查WH0规定的龋齿患病水平衡量标准。为了比较各国家，各地区龋齿的患病情况，WH0规定的龋齿患病水平以12岁（B对）儿童龋均为衡量标准。5～8岁（A错）、12～15岁（C错）、15岁（D错）、25岁（E错）不是国际衡量标准。